属于促凝血因子合成的药物是
A. 蛇毒血凝酶
B. 甲萘氢醌
C. 鱼精蛋白
D. 卡巴克络
E. 氨基己酸

正确答案：B。甲萘氢醌

解析：本题考查促凝血药的分类。甲萘氢醌（B对）属于促凝血因子合成药。蛇毒血凝酶（A错）、鱼精蛋白（C错）、卡巴克络（D错）均为影响血管通透性药。氨基己酸（E错）为抗纤维蛋白溶解药。